天花粉不具有的功效是
A. 清热
B. 生津
C. 凉血利尿
D. 清肺润燥
E. 消肿排脓

正确答案：C。凉血利尿

解析：本题考查的是天花粉的功效。天花粉不具有的功效是凉血利尿（C错，为本题正确答案）。天花粉：【功效】清热（A对）生津（B对），清肺润燥（D对），消肿排脓（E对）。凉血利尿为栀子的功效。栀子：【功效】泻火除烦，清热利尿，凉血解毒，消肿止痛。